缩余釉上皮的形成与下列的哪种细胞无关
A. 内釉上皮
B. 外釉上皮
C. 成釉细胞
D. 中间层
E. 成牙本质细胞

正确答案：E。成牙本质细胞

解析：釉质发育完成后，成釉细胞、中间层与外釉上皮细胞结合，形成一层鳞状上皮覆盖在釉小皮上，称为缩余釉上皮。而内釉上皮分化成为成釉细胞，故缩余釉上皮的形成与成牙本质细胞无关。掌握“牙体、牙周组织的形成”知识点。